磺胺嘧啶的鉴别方法有
A. 取铂丝，用盐酸湿润后，蘸取供试品，在无色火焰中燃烧，火焰呈现鲜黄色
B. 与香草醛反应，生成黄色产物，熔点为228～231℃
C. 加稀盐酸和亚硝酸钠试液，再滴加碱性β-萘酚试液，生成橙黄色至猩红色沉淀
D. 加水与0.4%的氢氧化钠试液使样品溶解，加硫酸铜试液1滴，生成黄绿色沉淀，放置后变为紫色
E. 加水溶解后，加硝酸，即显红色，渐变为淡黄色

正确答案：C、D。加稀盐酸和亚硝酸钠试液，再滴加碱性β-萘酚试液，生成橙黄色至猩红色沉淀；加水与0.4%的氢氧化钠试液使样品溶解，加硫酸铜试液1滴，生成黄绿色沉淀，放置后变为紫色